含三氮唑结构的抗病毒药物是
A. 氟康唑
B. 克霉唑
C. 来曲唑
D. 利巴韦林
E. 阿昔洛韦

正确答案：D。利巴韦林

解析：本题考查非核苷类抗病毒药。利巴韦林（D对）含一个三氮唑环，是广谱抗病毒药物。氟康唑（A错）、克霉唑（B错）均为抗真菌药物。来曲唑（C错）为抗肿瘤药物。阿昔洛韦（E错）不含三氮唑结构。